下列服用四环素后可导致恒牙变色的是
A. 胚胎29周之前
B. 胚胎29周至胎儿出生
C. 出生至8岁之间
D. 8岁之后
E. 以上均不正确

正确答案：C。出生至8岁之间

解析：在出生至8岁之间摄入四环素，可导致恒牙变色，故在此期间特别要注意慎用四环素。掌握“氟牙症、先天性梅毒牙与牙本质形成缺陷”知识点。